关于高血压药物治疗方案的叙述，错误的是
A. 首先选用血管扩张剂或中枢性抗高血压药
B. 采用最小有效剂量使不良反应减至最少
C. 最好选用一天一次持续24小时降压的制剂
D. 可以采用两种或两种以上的药物联合治疗
E. 药物治疗高血压时要考虑患者的合并症

正确答案：A。首先选用血管扩张剂或中枢性抗高血压药

解析：本题考查高血压的治疗。关于高血压药物治疗方案的叙述，错误的是首先选用血管扩张剂或中枢性抗高血压药（A错，为本题正确答案）。降压药物应用基本原则：（1）起始剂量宜小（B对）。一般患者采用常规剂量；老年人及高龄老年人初始治疗时通常应采用较小的有效治疗剂量。根据需要，可考虑逐渐增加至足剂量。（2）优先选择长效降压药物（C对）。优先使用长效降压药物（如苯磺酸氨氯地平、硝苯地平控释片、琥珀酸美托洛尔），以有效、平稳地控制24小时血压，更有效预防心脑血管并发症的发生。（3）联合治疗（D对）。对血压≥160/100mmHg、高于目标血压20/10mmHg的高危和很高危患者，或单药治疗未达标的高血压患者应进行联合降压治疗，包括自由联合或固定复方制剂。对血压≥140/90mmHg的患者，也可采取起始小剂量的联合治疗方案。（4）个体化治疗（E对）。根据患者合并症的不同和药物疗效及耐受性，以及患者个人意愿或长期承受能力，选择适合患者个体的降压药物。